位于大腿肌后群外侧的是
A. 半腱肌
B. 半膜肌
C. 股二头肌
D. 股四头肌
E. 股外侧肌

正确答案：C。股二头肌

解析：半腱肌（A错）和半膜肌（B错）均位于大腿肌后群内侧。股二头肌（C对）大腿肌后群外侧。股外侧肌（E错）属于股四头肌（D错），位于大腿肌前群。